小茴香长于治疗
A. 亡阳厥逆
B. 厥阴头痛
C. 寒饮咳喘
D. 虚阳上浮
E. 寒疝腹痛

正确答案：E。寒疝腹痛

解析：小茴香功效是散寒止痛，理气和胃；本品辛温，能温肾暖肝，散寒止痛，用治应寒疝腹痛（E对）。附子长于治疗亡阳厥逆（A错），肾阳虚衰，阳痿宫冷。吴茱萸长于治疗厥阴头痛（B错），寒湿脚气。干姜长于治疗脘腹冷痛，呕吐泄泻，寒饮咳喘（C错）。肉桂长于治疗肾虚作喘，虚阳上浮（D错），眩晕目赤。